小儿食指络脉显于命关为
A. 邪气入经
B. 邪气入络
C. 邪入脏腑
D. 邪犯皮毛
E. 邪入关节

正确答案：C。邪入脏腑

解析：根据络脉在食指三关出现的部位，可以测定邪气的浅深、病情的轻重。指纹达于命关，是邪入脏腑，病情严重（C对）。邪气入经（A错）时指纹达于气关，邪深病重。邪气入络（B错）时指纹显于风关，邪浅病轻，可见于外感初起。